原型无效，需经代谢后产生活性的药物是
A. 甲苯磺丁脲
B. 普萘洛尔
C. 氯吡格雷
D. 地西泮
E. 丙米嗪

正确答案：C。氯吡格雷

解析：本题考查氯吡格雷。原形无效，需经代谢后产生活性的药物是氯吡格雷（C对）。氯吡格雷为前药，必须经肝酶和脂酶代谢产生活性成分与血小板P2Y12受体结合，才能发挥抗血小板作用。甲苯磺丁脲（A错）属于第一代磺酰脲类降糖药，主要通过刺激胰岛B细胞分泌胰岛素，增加门静脉胰岛素水平，直接抑制肝糖原分解和糖异生作用，使肝生成和输出葡萄糖减少，增加胰外组织对胰岛素的敏感性和糖的利用，降低血糖。普萘洛尔（B错）是具有氨基醇结构的β受体阻滞剂，为非选择性β-受体阻断药，能够阻断心肌的β受体，对β₁和β₂受体均有拮抗作用。地西泮（D错）为长效苯二氮䓬类镇静催眠药，用于焦虑、镇静催眠、抗惊厥，并缓解炎症所引起的反射性肌肉痉挛等。丙咪嗪（E错）为三环类抗抑郁药，该类药主要通过抑制突触前膜对5-HT及去甲肾上腺素的再摄取，使突触间隙的去甲肾上腺素和5-HT浓度升高，促进突触传递功能而发挥抗抑郁作用。